CsA是目前临床上最广泛应用的免疫抑制药，其作用机制错误的
A. 直接抑制Th细胞
B. 间接抑制Th细胞
C. 抑制活化的B细胞表达IL-2受体
D. 抑制活化的T细胞表达IL-2受体
E. 间接抑制Th细胞IL-2等细胞因子

正确答案：C。抑制活化的B细胞表达IL-2受体

解析：免疫抑制：防治移植排斥反应最有效的措施是给予免疫抑制药，如糖皮质激素、环孢素（CsA）、FK506、西罗莫司和环磷酰胺等，其中CsA是目前临床上最广泛应用的免疫抑制药，其作用机制是直接或间接抑制Th细胞IL-2等细胞因子，抑制活化的T细胞表达IL-2受体。掌握“移植免疫”知识点。